硬脑膜与颅骨之间的关系
A. 硬脑膜位于颅骨的外面
B. 硬脑膜即是颅骨骨内膜
C. 颅底骨折时硬脑膜易撕裂而致脑脊液外漏
D. 硬脑膜与颅盖骨连接紧密
E. 无

正确答案：C。颅底骨折时硬脑膜易撕裂而致脑脊液外漏

解析：颅底骨折时硬脑膜易撕裂而致脑脊液外漏，这是由于在颅底处硬脑膜与颅骨结合紧密，颅底骨折时易将硬脑膜与脑蛛网膜同时撕裂，而脑蛛网膜和软脑膜之间充满脑脊液，脑蛛网膜撕裂使脑脊液外漏（C对）。硬脑膜外层为颅骨内面的骨膜（AB错），其与颅盖骨连接疏松（D错），易于分离。